6个月以内婴儿无热性支气管肺炎应考虑
A. 葡萄球菌肺炎
B. 合胞病毒肺炎
C. 革兰阴性杆菌肺炎
D. 肺炎支原体肺炎
E. 衣原体肺炎

正确答案：E。衣原体肺炎

解析：六个月以内婴儿无热性支气管肺炎应考虑衣原体肺炎。肺炎衣原体肺部感染的临床症状及X线表现均无特异性，不能和其他非典型肺炎相区别，确诊有赖于实验室诊断，最可靠的方法是进行肺炎衣原体的培养（E对）。葡萄球菌肺炎是由葡萄球菌所引起的急性化脓性肺部炎症，表现为寒战、高热、脓性痰、胸痛等症状（A错）。合胞病毒肺炎，是一种小儿常见的间质性肺炎，多发生于婴幼儿（B错）。革兰阴性杆菌肺炎是指革兰阴性杆菌引起的肺炎（C错）。肺炎支原体肺炎多数为亚急性起病，发热无定型，或体温正常，咳嗽较重，初期为刺激性干咳，常有咽痛，头痛等症状（D错）。